与盐酸-镁粉反应呈阳性的化合物是
A. 7-羟基黄酮
B. 七叶内酯
C. 大黄酸
D. 苦参碱
E. 葡萄糖醛酸

正确答案：A。7-羟基黄酮

解析：本题考查中药化学成分的显色反应。与盐酸-镁粉反应呈阳性的化合物是7-羟基黄酮（A对）。盐酸-镁粉（或锌粉）反应是鉴别黄酮类化合物最常用的颜色反应。多数黄酮、黄酮醇、二氢黄酮及二氢黄酮醇类化合物显橙红色至紫红色，少数显紫色至蓝色，当B-环上有-OH或-OCH，取代时，呈现的颜色亦即随之加深。根据苷元的结构可分为氰苷、香豆素苷、木脂素苷、蒽醌苷、黄酮苷、吲哚苷等。如苦杏仁苷、七叶内酯苷（B错）、靛苷。苷元的结构多种多样。糖的显色反应中最重要的是Molish反应。Bornträger's反应：在碱性溶液中，羟基醌类颜色改变并加深，多呈橙、红、紫红及蓝色。如羟基蒽醌类化合物遇碱显红至紫红色，称为Bornträger's反应。大黄酸蒽酮（C错）为二蒽酮类化合物。碘化铋钾试剂为生物碱类沉淀试剂，反应特征为黄色至橘红色无定形沉淀。苦参碱（D错）为吡啶类生物碱。黄芩经过蒸制或沸水煮既可杀酶保苷，防止将黄芩中的黄芩苷和汉黄芩苷酶分解成葡萄糖醛酸（E错）和黄芩素与汉黄芩素。